上6髓角最高的是
A. 近中颊侧髓角
B. 远中髓角
C. 近中舌侧髓角
D. 远中舌侧髓角
E. 近中髓角

正确答案：A。近中颊侧髓角

解析：本题考查恒牙的髓腔解剖形态。上6髓角最高的是近中颊侧髓角（A对）。上颌第一磨牙的髓室似矮长方体形，髓室高度很小，颊舌径＞近远中径＞髓室高度。髓室顶形凹，最凹处约与颈缘平齐。髓室顶上近颊髓角和近舌髓角较高，二者均接近牙冠中1/3；远颊髓角和远舌髓角较低，均接近牙冠颈1/3处。